女性，27岁。产后第4天，出现寒战高热腰痛，尿白细胞30个/HP，尿蛋白（+），并尿痛，下腹痛，肾区叩击痛，耻骨上压痛（+），血象WBC18×10⁹/L，应该如何选择用药
A. 应先观察体温热型，查出病后再做处理
B. 暂不用抗生素，待细菌培养结果，药敏结果出来后再用抗生素
C. 治疗应在取尿标本送检后立即进行
D. 首先运用广谱抗生素
E. 抗生素治疗时少饮水

正确答案：C。治疗应在取尿标本送检后立即进行

解析：27岁女性患者，产后第4天出现寒战高热腰痛，有尿痛和下腹痛症状，肾区叩击痛，耻骨上压痛（+），尿白细胞升高，尿蛋白（+），血白细胞升高，产后发热，首先考虑产褥感染。首先取尿标本送检，以免应用抗生素后干扰试验结果（D错）。然后立即根据临床表现及临床经验，选用广谱高效抗生素（C对），抗生素治疗时应多饮水（E错），然后依据细菌培养和药敏试验结果，调整抗生素种类和剂量（B错）。体温热型对用药指导价值很小，因此应先观察体温热型、查出病后再做处理（A错）不恰当。